不属于肉芽肿性炎病变的是
A. 伤寒小结
B. 结核结节
C. 肺肉质变
D. 慢性虫卵结节
E. 梅毒

正确答案：C。肺肉质变

解析：肉芽肿性炎是以肉芽肿形成为特点，包括伤寒小结（A对）、结核结节（B对）、慢性虫卵结节（D对）、梅毒（E对）、麻风等。肺肉质变是指肺内炎性灶内中性粒细胞渗出过少，蛋白酶不能溶解大量纤维素，纤维素被肉芽组织取代、机化导致褐色肉芽样外观与肉芽肿的形成无关（C错，为本题正确答案）。